治疗钩端螺旋体病、梅毒及回归热宜选用的药物是
A. 青霉素
B. 四环素
C. 庆大霉素
D. 氯霉素
E. 头孢唑林

正确答案：A。青霉素

解析：本题考查青霉素。青霉素（A对）为青霉素类抗菌药物，是治疗钩端螺旋体病、梅毒及回归热的首选药。四环素（B错）临床用于立克次体病、支原体属感染、回归热、布鲁斯病、霍乱、兔热病及鼠疫等。庆大霉素（C错）临床主要用于敏感革兰阴性杆菌所致的严重感染，如败血症、下呼吸道感染、肠道感染、盆腔感染、腹腔感染、皮肤软组织感染、复杂性尿路感染等。氯霉素（D错）用于某些中枢神经系统感染、伤寒和副伤寒，厌氧菌感及立克次体感染。头孢唑林（E错）主要作用于需氧革兰阳性球菌，仅对少数肠杆菌科细菌有一定抗菌活性，用于敏感细菌所致的中耳炎、支气管炎、肺炎等呼吸道感染、尿路感染、皮肤软组织感染、骨和关节感染、败血症、感染性心内膜炎及肝脏系统感染等。